膈与呼吸运动的关系是
A. 收缩时，膈穹上升，助吸气
B. 收缩时，膈穹下降，助呼气
C. 舒张时，膈穹上升，助吸气
D. 舒张时，膈穹下降，助呼气
E. 收缩时，膈穹下降，助吸气

正确答案：E。收缩时，膈穹下降，助吸气

解析：膈与呼吸运动的关系是：收缩时，膈穹下降，而非上升（A错），助吸气（E对），而非助呼气（B错）；舒张时，膈穹上升，而非下降（D错），助呼气，而非助吸气（C错）。